以下情况会加大基牙的负担，除了
A. 缺牙数目多、缺牙间隙长
B. 基托下黏膜松软、移动度大
C. 卡环与基牙牙冠表面接触面大，卡环刚性大
D. 牙槽嵴丰满
E. 义齿欠稳定，咬合不平衡

正确答案：D。牙槽嵴丰满

解析：本题考查会加大基牙负担的情况。以下情况会加大基牙的负担，除了牙槽嵴丰满（D错，为本题的正确答案）。牙槽嵴丰满，则缺牙区软硬组织可以提供足够的支持，就可以减少基牙的负担。缺牙数目多、缺牙间隙长（A对），则可利用的基牙数目少，每个基牙的负担就会加重。修复体所受的力由基牙和缺牙区牙槽嵴共同承担的时，当基托下黏膜松软、移动度大（B对）时，缺牙区牙槽嵴的黏膜软组织可提供的支持力非常有限，故基牙的负担增加。卡环与基牙牙冠表面接触面大，卡环刚性大（C对），则卡环每次卡上与摘下时，都会对基牙造成较大的负担。义齿欠稳定，咬合不平衡（E对），则基牙受力不一致，加大基牙的负担。